药物产生毒性反应的原因有
A. 用药剂量过大
B. 机体对药物过于敏感
C. 药物有抗原性
D. 用药时间过长
E. 机体有遗传性疾病

正确答案：A、D。用药剂量过大；用药时间过长

解析：本题考查药品的不良反应。药物产生毒性反应的原因有药物剂量过大（A对）、用药时间过长（D对）。毒性反应是指在剂量过大或药物在体内蓄积过多时发生的危害性反应。机体对药物过于敏感（B错）和药物有抗原性（C错）是药物产生过敏反应的原因。机体有遗传性疾病（E错）是药物产生特异质反应的原因。